关于牙的叙述，不正确的是
A. 牙是身体最硬的器官
B. 由牙本质、牙釉质、牙骨质及牙髓构成
C. 据形态和功能，牙可分为切牙、尖牙、前磨牙和磨牙
D. 可分为牙冠、牙根、牙颈和牙髓腔四部分
E. 乳牙为20颗，恒牙为28~32颗

正确答案：D。可分为牙冠、牙根、牙颈和牙髓腔四部分

解析：牙是人体最坚硬的器官(A对)，由牙质、牙釉质、牙骨质及牙髓构成(B对)，可分为切牙、尖牙、前磨牙和磨牙(C对)，可分为牙冠、牙根和牙颈3部分(D错，为本题正确答案)，乳牙共20颗，恒牙全部长齐为32颗，有第三磨牙不萌出者可能为28-32颗(E对)。